禁用皮质类固醇的疾病是
A. 扁平苔藓
B. 盘状红斑狼疮
C. 单纯和带状疱疹
D. 复发性口腔溃疡
E. 多形红斑

正确答案：C。单纯和带状疱疹

解析：本题考查疱疹性口炎的治疗。单纯疱疹和带状疱疹（C对）的病原菌为病毒，治疗时局部或全身应禁用皮质类固醇药物，以免病毒扩散产生严重后果。糜烂型扁平苔藓（A错）和复发性口腔溃疡（D错）都可使用肾上腺皮质激素进行局部封闭，减轻疼痛促进愈合。局部单独使用糖皮质激素或联合用药，对盘状红斑狼疮（B错）的疗效较肯定。多形性红斑（E错）的药物治疗应特别注意给予泼尼松治疗，但在口腔糜烂和渗出症状控制后应逐渐减量。